决定肺部气体交换方向的最主要因素是
A. 气体溶解度
B. 气体分压差
C. 气体分子量大小
D. 呼吸膜通透性
E. 气体和血红蛋白的亲和力

正确答案：B。气体分压差